女性，19岁。近二周来发热38℃左右，伴恶心、呕吐、腹泻。遂出现心悸、胸痛、呼吸困难，晕厥发作。体检发现：面色苍白，精神萎糜。心率40次/分，律齐，心尖部第一心音低钝，且可闻及大炮音。临床诊断病毒性心肌炎。最适宜的治疗措施为
A. 静脉注射阿托品
B. 静脉滴注硝酸甘油
C. 皮下注射肾上腺素
D. 临时植入心脏起搏器
E. 心脏复律

正确答案：D。临时植入心脏起搏器

解析：患者年轻女性，病毒性心肌炎诊断明确，心尖部第一心音低钝，心率40次/分（正常值60～100次/分，严重偏慢），且可闻及大炮音（完全性房室传导阻滞的典型体征），提示患者有病毒性心肌炎伴完全性房室传导阻滞。患者有晕厥发作，面色苍白，精神萎糜等组织血液灌流不足的表现，可能为完全性房室传导阻滞导致心室率极慢，左心室心输出量降低所致。对于完全性房室传导阻滞而出现晕厥的病毒性心肌炎患者最适宜的治疗措施为临时植入心脏起搏器（D对）。静脉注射阿托品（A错）可提高房室阻滞的心率，多用于阻滞位于房室结的患者。但适用于无心脏起搏条件的应急情况。硝酸甘油（P232）（B错）可扩张正常和粥样硬化的冠状动脉，缓解心肌缺血，主要用于冠心病心绞痛的治疗和预防。对于房室传导阻滞的患者多可静脉滴注异丙肾上腺素治疗，而皮下注射肾上腺素（C错）常用于治疗过敏性休克和心脏骤停。心脏复律（E错）是指原先的心律失常的异常起搏点恢复为正常的窦性心律，但本例为完全性房室传导阻滞，并非心脏节律异常。